为了预测流感的流行动态，以中小学生缺课情况作为监测指标进行监测，这种监测方法属于
A. 哨点报告
B. 常规监测
C. 主动监测
D. 症状监测
E. 被动监测

正确答案：D。症状监测

解析：本题考查症状监测。症状监测是指通过长期、连续、系统地收集特定临床症候群或与疾病相关现象的发生频率，从而对某类疾病的发生或流行进行早期探查、预警和做出快速反应的监测方法。常用的症状监测主要有流感症状（咳嗽、喷嚏等）监测、发热监测、腹泻病监测等。为了预测流感的流行动态，以中小学生缺课情况作为监测指标进行监测，这种监测方法属于症状监测（D对ABCE错）。